静脉注射吸毒是艾滋病毒感染的
A. 直接病因
B. 间接病因
C. 同机制有关的近因
D. 必要病因
E. 充分病因

正确答案：B。间接病因

解析：本题考查间接病因。静脉注射吸毒是艾滋病毒感染的间接病因（B对ACDE错）。在病因链“静脉注射吸毒→共同使用注射器→注射器污染HIV→病毒感染→艾滋病发作”之中，HIV感染称为直接病因，而它以前的因素都称为间接病因。